心左界，主要构成部分是
A. 左心房
B. 主动脉弓
C. 肺动脉段
D. 左心室
E. 支气管分叉处

正确答案：D。左心室

解析：心脏左界第二肋间处相当于肺动脉段，第三肋间为左心耳，第四、五肋间为左心室，主要构成部分是左心室（D对）。右界第二肋间相当于升主动脉和上腔静脉，第三肋间以下为右心房。心上界相当于第三肋骨前端下缘水平，第二肋间以上又称心底部浊音区，相当于主动脉（B错）、肺动脉段（C错），主动脉与左心室交接处向内凹陷，称为心腰。心下界由右心室及左心室心尖部组成。左心房（A错）叩诊不易扣出。支气管分叉处（E错）称为隆突，然后分为左右主支气管。